布洛芬主要用于治疗
A. 头痛、牙痛
B. 肌肉痛、神经痛
C. 痛经
D. 感冒发烧
E. 风湿、类风湿关节炎

正确答案：E。风湿、类风湿关节炎